医疗机构违反规定，使用非卫生技术人员从事医疗卫生技术工作的，由县级以上人民政府卫生行政部门责令其限期改正，并
A. 1千元以下罚款
B. 3千元以下罚款
C. 5千元以下罚款
D. 8千元以下罚款
E. 吊销《医疗机构执业许可证》

正确答案：C。5千元以下罚款

解析：医疗机构违反规定，使用非卫生技术人员从事医疗卫生技术工作的，由县级以上人民政府卫生行政部门责令其限期改正，并可以处以5千元以下的罚款，情节严重的，吊销其《医疗机构执业许可证》。掌握“医疗机构登记和校验及法律责任”知识点。